以下关于沃辛瘤的病理表现的说法错误的是
A. 质地柔软，囊性感
B. 包膜完整，界限清楚
C. 剖面暗红，囊内有黏液
D. 囊腔结构，大小不一
E. 内衬上皮单层细胞排列

正确答案：E。内衬上皮单层细胞排列

解析：沃辛瘤肿瘤呈圆形或卵圆形，质地柔软，可有囊性感。包膜完整，界限清楚。剖面常有大小不等的囊腔，呈灰褐色或暗红色。囊内可有黏液样物溢出。光镜观察，肿瘤由上皮和淋巴样组织构成。肿瘤上皮细胞形成大小和形态不一的腺管或囊腔样结构，有乳头突入囊腔。囊腔内衬上皮由双层细胞构成。掌握“沃辛瘤及嗜酸性腺瘤”知识点。